女，23岁。腹痛、腹泻、里急后重伴发热半天。查体：T39.2℃，BP126/80mmHg，腹软，左下腹压痛（+），反跳痛（-）。实验室检查：血WBC18×10⁹/L.N0.87，L0.13。粪镜检WBC满视野，RBC20/HP。最可能的诊断是
A. 急性细菌性痢疾
B. 急性阑尾炎
C. 急性阿米巴痢疾
D. 霍乱
E. 急性肠炎

正确答案：A。急性细菌性痢疾

解析：急性细菌性痢疾是常见的一种肠道传染病，由痢疾杆菌所致。主要表现为腹痛、腹泻、里急后重及排黏液脓血便（A对）。急性阑尾炎（B错）有典型转移性右下腹痛；急性阿米巴痢疾（C错）有果酱样黏液脓血便，且有腥臭；霍乱（D错）有剧烈腹泻，次数多，无里急后重；急性肠炎（E错）少有里急后重，腹部压痛。